销售前应当按规定在指定药品检验机构进行检验或者审核批准的是
A. 血液制品
B. 中药饮片
C. 化学原料药
D. 医院制剂
E. 中成药

正确答案：A。血液制品

解析：本题考查的是药品质量监督检验的类型。销售前应当按规定在指定药品检验机构进行检验或者审核批准的是血液制品（A对）。药品的指定检验：是指国家法律或国家药品监督管理部门规定某些药品在销售前或者进口时，必须经过指定药品检验机构检验，检验合格的，才准予销售的强制性药品检验。《药品管理法》规定下列药品在销售前或者进口时，必须经过指定药品检验机构进行检验，检验不合格的，不得销售或者进口：①首次在中国销售的药品；②国家药品监督管理部门规定的生物制品；③国务院规定的其他药品。对于这些药品，虽然已经取得药品生产批准证明文件，并经药品生产企业检验合格，但是，如果在销售前没有经过药品检验机构对其药品实施检验，仍然会认定该销售行为是违法行为。许多国家的药事法中都有这项强制性检验的规定，主要是针对一些存在安全性隐患，需要加强管理的品种，实施上市前的检验行为，这也是我国对这些药品进行“批签发”管理的组成部分。2017年12月29日，国家食品药品监督管理总局发布修订后的《生物制品批签发管理办法》（总局令第39号）（自2018年2月1日起施行），强化生物制品批签发管理工作。批签发是指国家药品监管部门为确保疫苗等生物制品的安全、有效，在每批产品上市前由指定的药品检验机构对其进行审核、检验及签发的监督管理行为。这种作法是国际上对疫苗等生物制品监管的一种通行做法，被世界卫生组织列为各国政府对疫苗类生物制品实行监管的关键职能之一。疫苗类制品、血液制品、用于血源筛查的体外诊断试剂以及国家药品监督管理部门规定的其他生物制品，在每批产品上市销售前或进口时，都应当通过批签发审核检验。未通过批签发的产品，不得上市销售或进口。